能够发育成舌骨大角和舌骨体下部的软骨为
A. 第一鳃弓软骨
B. 第二鳃弓软骨
C. 第三鳃弓软骨
D. 第四鳃弓软骨
E. 第五鳃弓软骨

正确答案：C。第三鳃弓软骨

解析：第三鳃弓软骨形成舌骨大角和舌骨体下部。掌握“鳃弓与神经嵴”知识点。